复方丹参片的功能有
A. 活血化瘀
B. 清心除烦
C. 解毒消肿
D. 通脉活络
E. 理气止痛

正确答案：A、E。活血化瘀；理气止痛

解析：本题考查的是复方丹参片的功能。复方丹参片的功能有活血化瘀（A对）与理气止痛（E对）。复方丹参片：【功能】活血化瘀，理气止痛。丹参：【功效】活血祛瘀，通经止痛，清心除烦（B错），凉血消痈。清胃黄连丸：【功能】清胃泻火，解毒消肿（C错）。血塞通颗粒：【功能】活血祛瘀，通脉活络（D错）。